法律规定了允许骑摩托车的最小年龄，这属于下面哪种干预措施
A. 主动干预
B. 教育干预
C. 技术干预
D. 强制干预
E. 紧急处置

正确答案：D。强制干预